男，32岁。间断上腹痛3年。腹痛多发生在饥饿时，进食后可缓解。查体：T36.5℃，P80次/分，R18次/分，BP100/60mmHg。双肺呼吸音清，未闻及干湿性啰音，心律齐，腹软，无压痛。胃镜检查：十二指肠溃疡愈合期，¹³C尿素呼气实验阳性。最有效的治疗方案是
A. 奥美拉唑+枸缘酸铋钾+克拉霉素
B. 西米咪替丁+克拉霉素+左氧氟沙星
C. 奥美拉唑+阿莫西林+替硝唑+枸缘酸铋钾
D. 奥美拉唑+硫糖铝
E. 法莫替丁+阿莫西林+克拉霉素+铝碳酸镁

正确答案：C。奥美拉唑+阿莫西林+替硝唑+枸缘酸铋钾

解析：中青年男性，间断上腹痛3年。腹痛多发生在饥饿时（十二指肠溃疡为饥饿痛），进食后可缓解。查体：T36.5℃，P80次/分，R18次/分，BP100/60mmHg。双肺呼吸音清，未闻及干湿性啰音，心律齐，腹软，无压痛。胃镜检查：十二指肠溃疡愈合期，¹³C尿素呼气实验阳性，结合该患者病史、体查和胃镜检查，可诊断为十二指肠溃疡。十二指肠溃疡患者的Hp（幽门螺杆菌）感染率高达90%～100%，所以治疗十二指肠溃疡首选根除幽门螺杆菌治疗，常采用三联疗法（1种PPI+2种抗生素或1种铋剂+2种抗生素）或四联疗法（1种PPI+2种抗生素+1种铋剂），如奥美拉唑+阿莫西林+替硝唑+枸缘酸铋钾（C对）。奥美拉唑+枸缘酸铋钾+克拉霉素（A错）、西米咪替丁+克拉霉素+左氧氟沙星（B错）、奥美拉唑+硫糖铝（D错）、法莫替丁+阿莫西林+克拉霉素+铝碳酸镁（E错）都不是正规的消化性溃疡的治疗方案。